含酚羟基的香豆素类化合物具有的性质或反应有
A. 荧光性质
B. 异羟肟酸铁反应
C. Gibb'S反应
D. Kedde反应
E. Emerson反应

正确答案：A、B、C、E。荧光性质；异羟肟酸铁反应；Gibb'S反应；Emerson反应